甲状旁腺激素的功能是调节血液中的
A. 锌
B. 钠
C. 钙
D. 钾
E. 镁

正确答案：C。钙